男，60岁。2型糖尿病6年，因糖尿病酮症酸中毒入院。查体：BP130/50mmHg，心率105次/分，心律齐，血糖21mmol/L，血钠145mmol/L，血钾4.2mmol/L，血钙20mmol/L，血磷11mmol/L，血碳酸氢盐12mmol/L，尿糖（++++），酮体（+++）。经静脉补液和滴注胰岛素治疗后，尿糖（+），酮体阴性，但出现严重室性心律失常，心律失常最可能的原因是
A. 低血钾
B. 低血钠
C. 低血糖
D. 低血钙
E. 低血磷

正确答案：A。低血钾

解析：糖尿病酮症酸中毒渗透性利尿作用使钾大量丢失，导致细胞内失钾，体内严重缺钾，但是由于血液浓缩，肾功能减退以及酸中毒时钾离子从细胞内转移到细胞外，因此血钾浓度可保持正常（P752），尽管该患者血钾4.2mmol/L处于正常范围（正常值3.5mmol/L～5.5mmol/L），但治疗前的血钾水平不能真实反映体内缺钾程度，而在进行静脉补液以及滴注胰岛素治疗后，稀释了血液，并促进钾离子进入细胞内，同时没有及时补钾，最终导致低血钾，低血钾（A对）引起心肌兴奋性及自律性增高，出现室性心律失常。糖尿病酮症酸中毒经补液后较少出现低血钠，且低血钠（B错）一般不会出现心律失常。低血糖（C错）常会出现大汗、饥饿、感觉异常、颤抖、心悸、紧张、焦虑等症状（P750），室性心律失常少见。低血钙（D错）常见症状一般为神经肌肉兴奋性增高、口周和指尖麻木及针刺感、手足抽搐、腱反射亢进以及Chvostek征阳性（九版外科学P16），室性心律失常少见。低血磷（E错）可见神经肌肉症状如头晕、厌食、肌无力等，重症者可有抽搐、精神错乱、昏迷甚至可因呼吸肌无力而危及生命（九版外科学P17），室性心律失常少见。